唾液量测定判断分泌减少的标准是5g白蜡咀嚼3分钟，全唾液量低于
A. 1ml
B. 2ml
C. 3ml
D. 4ml
E. 5ml

正确答案：C。3ml

解析：唾液流量测定：一般用5g白蜡咀嚼3分钟，全唾液量低于3ml为分泌减少。掌握“舍格伦综合征”知识点。